患者，男，20岁，右下第一磨牙（牙合）面龋洞，深达牙本质浅层，探稍敏感，冷刺激进洞后稍敏感。根据上述症状该患牙的诊断可能为
A. 浅龋
B. 可复性牙髓炎
C. 深龋
D. 慢性牙髓炎
E. 中龋

正确答案：E。中龋

解析：中龋的龋损进展到牙本质浅层，一般对冷热酸甜（尤其后者）一过性敏感。掌握“龋病的诊断及鉴别诊断”知识点。